肝硬化门脉高压患者，出现全血细胞减少最主要的原因是
A. 营养不良
B. 脾功能亢进
C. 溶血
D. 消化道出血
E. 病毒感染

正确答案：B。脾功能亢进

解析：肝硬化门静脉高压症的临床表现为腹水、门-腔侧支循环开放与脾肿大、脾功能亢进。其中，脾功能亢进可表现为外周血全血细胞减少（B对）；门-腔侧支循环开放表现为食管胃底静脉曲张、痔核、腹壁静脉扩张；腹水表现为腹胀，移动性浊音阳性。营养不良（A错）常表现为贫血，溶血（C错）表现为红细胞破坏增多，二者红细胞减少，白细胞和血小板正常。消化道出血（D错）可引起全血细胞减少，但不是主要原因。病毒感染（E错）不会引起全血细胞减少。